健康教育活动包括以下几个步骤，其中第一步应进行
A. 干预计划制定
B. 健康教育诊断
C. 计划实施准备
D. 计划实施
E. 计划的评价

正确答案：B。健康教育诊断